导致血浆二氧化碳分压升高的原因是
A. 精神性通气过度
B. 严重的喉头痉挛
C. 甲亢
D. 人工呼吸机通气量过大
E. 高热

正确答案：B。严重的喉头痉挛

解析：严重的喉头痉挛（B对）堵塞气管导致CO2无法排出导致血浆二氧化碳分压升高。精神性通气过度（A错）、甲亢（C错）和高热（E错）刺激引起呼吸中枢兴奋、人工呼吸机通气量过大（D错）都可引起血浆二氧化碳分压降低而发生呼吸性碱中毒。